正治是临床常用的治则，主要治法有
A. 以热治寒
B. 以热治热
C. 以寒治寒
D. 以通治通
E. 以寒治热

正确答案：A、E。以热治寒；以寒治热

解析：本题考查正治的治法。正治是临床常用的治则，主要治法有以热治寒（A对）、以寒治热（E对）。正治，又称逆治，是指采用方药的性质与疾病的证候性质相反的治疗法则。常用的治法有寒者热之、热者寒之、虚则补之、实则泻之等。寒者热之寒者热之又称“以热治寒”，是指寒性病证出现寒象，用温热方药进行治疗。热者寒之热者寒之又称“以寒治热”，是指热性病证出现热象，用寒凉方药进行治疗。反治，又称从治，是指顺从疾病证候的外在假象而治的治疗法则。反治，主要包括热因热用、寒因寒用、塞因塞用、通因通用四种治法。热因热用热因热用又称“以热治热（B错）”，是指针对假热的临床表现，用热性药物进行治疗。寒因寒用寒因寒用又称“以寒治寒（C错）”，是指针对假寒的临床表现，用寒性药物进行治疗。通因通用通因通用又称“以通治通（D错）”，是指针对通泄的临床表现，用通利药物进行治疗。